患者男性，20岁，大学生，3月份入院，因发热5天伴皮疹、咳嗽、咽部疼痛1天入院，体检：体温39.6℃，皮肤有淡红色，部分为暗红色的斑丘疹，以耳后、头面部，胸腹部为多，结膜红肿，浅表淋巴结未及。肝脾肋下未及。周围血液白细胞数为3.8×10⁹/L，N30%，L65%，红细胞为4.5×10¹²/L，血小板为15×10⁹/L，尿蛋白（+），本例最可能的诊断是
A. 流行性出血热
B. 登革热
C. 传染性单核细胞增多症
D. 钩端螺旋体病
E. 麻疹

正确答案：E。麻疹